女性，33岁，因牙齿松动就诊。检查：多数牙齿松动、移位，牙周袋探诊深度5～8mm。怀疑为侵袭性牙周炎，诊断前最为重要的辅助检查是
A. 拍摄X线片
B. 咬合检查
C. 家族史
D. 细菌学检查
E. 白细胞趋化功能检查

正确答案：A。拍摄X线片

解析：侵袭性牙周炎的诊断主要依靠临床表现和X线片上牙槽骨吸收情况，家族史和咬合情况对诊断有帮助，但不如X线片表现重要，细菌学检查和白细胞趋化功能检查对诊断有一定的参考意义，但不是临床常规使用的辅助检查手段。掌握“侵袭性牙周炎”知识点。